关于心排出量的叙述错误的是
A. 左心室大于右心室
B. 等于搏出量乘以心率
C. 动脉血压可影响心排出量
D. 随机体代谢需要而增加
E. 与静脉回心血量保持动态平衡

正确答案：A。左心室大于右心室